脾肾阳虚泄泻的临床特点是
A. 腹泻肠鸣，粪便臭如败卵，夹有不消化食物
B. 黎明之前，肠鸣腹痛，泻后则安，腰膝酸软
C. 泄泻腹痛，粪色黄褐，肛门灼热，烦热口渴
D. 大便溏泻，水谷不化，面色萎黄，食少倦怠
E. 紧张之时，腹痛欲便，便后痛减，时时叹息

正确答案：B。黎明之前，肠鸣腹痛，泻后则安，腰膝酸软

解析：本题考查的是泄泻的辨证论治。脾肾阳虚泄泻的临床特点是黎明之前，肠鸣腹痛，泻后则安，腰膝酸软（B对）。泄泻是以排便次数增多，粪质稀溏或完谷不化，甚至泻出如水样为主症的疾病。西医学的急性肠炎、肠易激综合征、炎症性肠病等有上述表现者，可参考此内容辨证论治。（一）寒湿内盛证：【症状】泄泻清稀，甚则如水样，脘闷食少，腹痛肠鸣，或兼见外感风寒，恶寒，发热，头痛，肢体酸痛。舌苔白或白腻，脉濡缓。（二）湿热伤中证：【症状】泄泻腹痛，泻下急迫，势如水注，或泻而不爽，粪色黄褐，气味臭秽，肛门灼热，烦热口渴（C错），小便短黄。舌质红，苔黄腻，脉滑数或濡数。（三）食滞肠胃证：【症状】腹痛肠鸣，泻下粪便臭如败卵，泻后痛减，泻下伴有不消化食物（A错），脘腹胀满，嗳腐吞酸，不思饮食。舌淡红，苔垢浊或厚腻，脉滑实。（四）肝气乘脾证：【症状】腹痛而泻，腹中雷鸣，攻窜作痛，矢气频作，每因抑郁恼怒或情绪紧张之时而泻，素有胸胁胀闷，嗳气食少（E错）。舌质淡，脉弦。（五）脾胃虚弱证：【症状】大便时溏时泻，迁延反复，食少，食后脘闷不舒，稍进油腻食物，则大便次数增多，面色萎黄，神疲倦怠（D错）。舌质淡，苔白，脉细弱。（六）肾阳虚衰证：【症状】黎明前脐腹作痛，肠鸣即泻，泻后则安，完谷不化，腹部喜暖，形寒肢冷，腰膝酸软。舌淡苔白，脉沉细。